微静脉舒缩受
A. 神经调节
B. 体液调节
C. 两者均有
D. 两者均无
E. 无

正确答案：C。两者均有

解析：微静脉舒缩受神经（A对）体液（B对）的调节（C对ABDE错）。交感神经支配微静脉平滑肌，兴奋时通过α-肾上腺能受体使血管收缩，血流减少。全身性体液因子如儿茶酚胺、血管紧张素II、血管加压素、血栓素A2(TXA2 )和内皮素(ET)等可使微血管收缩；而局部血管活性物质如组胺、激肽、腺苷、PGI2、内啡肤、 TNF和一氧化氮( NO)等则引起血管舒张；乳酸等酸性产物的堆积则可降低血管平滑肌对缩血管物质的反应性，而导致血管扩张（AB对，C为本题正确答案）。